X线片上拔牙窝的影像完全消失至出现正常骨结构的时间，是在牙拔除后的
A. 6～8周
B. 3～6个月
C. 7～10个月
D. 11～12个月
E. 1年以上

正确答案：B。3～6个月

解析：本题考查拔牙创的愈合-成熟的骨组织替代不成熟骨质。X线片上拔牙窝的影像完全消失至出现正常骨结构的时间，是在牙拔除后的3～6个月（B对）。拔牙创愈合分为5个主要阶段：拔牙创出血和血凝块形成，血块机化、肉芽组织形成，结缔组织和上皮组织替代肉芽组织，原始的纤维样骨代替结缔组织，成熟的骨组织替代不成熟骨质。大约38d拔牙窝的2/3被纤维样骨组织充填，但此时骨质密度较低，X线检查仍可见到拔牙窝的影像；3～6个月后重建过程基本完成，出现正常骨结构。